医务人员必须经过省级卫生计生行政部门考核并取得相应的合格证书后方可从事的母婴保健项目是
A. 结扎手术
B. 家庭接生
C. 产前诊断
D. 婚前医学检查
E. 终止妊娠手术

正确答案：C。产前诊断

解析：经省级卫生行政部门批准，取得从事产前诊断的《母婴保健技术考核合格证书》是产前诊断技术人员的条件之一（C对）。